男，41岁，高热一个月，肝区疼痛半年。超声检查发现肝区多发小结节，大小1-2cm。血常规WBC13.4×10⁹/L，N0.83，肝穿刺见黄白相间条索状物，可见脓细胞和脓球，质软。该患者可能的诊断是
A. 慢性肝炎导致肝硬化
B. 肝脓肿
C. 亚急性重症肝炎
D. 肝细胞癌
E. 肝胆管细胞癌

正确答案：B。肝脓肿

解析：患者男，41岁，高热一个月，肝区疼痛半年（肝脓肿的表现）。超声检查发现肝区多发小结节，大小1-2cm。血常规WBC13.4×10⁹/L，N0.83，肝穿刺见黄白相间条索状物，可见脓细胞和脓球，质软（肝脓肿的辅助检查结果）。结合患者的表现和辅助检查，该患者可能的诊断是肝脓肿（B对）。（P418）”肝细胞癌, 简称肝癌 肝癌早期缺乏典型临床表现，出现症状和体征，疾病多已进入中、晚期。临床表现可能有肝区疼痛、肝大或右上腹肿块，乏力、消瘦、食欲减退、黄疸、腹胀等全身及消化道症状（D错）”。（P420）“肝内胆管癌（ICC）的临床表现与 HCC 相似，最常见的症状是右上腹疼痛和体重减轻，大约 25% 的病人出现黄疸（E错）”。